下列不属于牙结构异常的是
A. 牙釉质发育不全
B. 牙内陷
C. 牙本质发育不全
D. 先天性梅毒牙
E. 氟牙症

正确答案：B。牙内陷

解析：本题考查牙齿结构异常。牙内陷（B错，为本题的正确答案）属于牙齿形态异常。牙结构异常通常指的是在牙齿发育期间在牙基质形成或钙化时，受到各种障碍造成牙齿发育的不正常，并在牙体组织留下永久性的缺陷或痕迹。主要包括釉质发育不全（A对）、牙本质发育不全（C对）、氟牙症（E对）、先天性梅毒牙（D对）、萌出前牙冠内病损。